孕激素的作用
A. 促进子宫发育
B. 促进女性第二性征发育
C. 使阴道上皮细胞增生、角化
D. 通过中枢神经系统使体温升高0.3℃~0.5℃
E. 对防止高血压及冠状动脉硬化有一定的作用

正确答案：D。通过中枢神经系统使体温升高0.3℃~0.5℃

解析：孕激素能兴奋下丘脑体温调节中枢，可使基础体温在排卵后升高0.3~0.5摄氏度（D对），临床上可以此作为判定排卵日期的标志之一。促进子宫发育（A错）、促进女性第二性征发育（B错）、使阴道上皮细胞增生、角化（C错）和对防止高血压及冠状动脉硬化有一定的作用（E错）是雌激素的作用。